以下检验方法中，属于非参数检验方法的是
A. 方差分析
B. Z检验
C. t检验
D. H检验
E. q检验

正确答案：D。H检验